某女，18岁。患流行性感冒，症见发热恶风，头痛头晕，咳嗽，胸闷、咽喉肿痛，治当清热解表，宜选用的成药是
A. 羚羊感冒胶囊
B. 正柴胡饮颗粒
C. 表实感冒颗粒
D. 感冒清热颗粒
E. 双黄连合剂

正确答案：A。羚羊感冒胶囊

解析：本题考查的是羚羊感冒胶囊的功能。患流行性感冒，症见发热恶风，头痛头晕，咳嗽，胸闷、咽喉肿痛，治当清热解表，宜选用的成药是羚羊感冒胶囊（A对）。羚羊感冒胶囊：【功能】清热解表。正柴胡饮颗粒（B错）：【功能】发散风寒，解热止痛。表实感冒颗粒（C错）：【功能】发汗解表，祛风散寒。感冒清热颗粒（D错）：【功能】疏风散寒，解表清热。双黄连合剂（E错）：【功能】疏风解表，清热解毒。